颜面浮肿，面色㿠白，发病缓慢者，多由何因所致
A. 邪热亢盛，水湿泛滥
B. 脾肾阳虚，水湿泛滥
C. 外感风邪，肺失宣降
D. 阳明热毒，水湿泛滥
E. 血瘀痰阻，水湿泛滥

正确答案：B。脾肾阳虚，水湿泛滥

解析：颜面浮肿，是因为脾肾阳虚，不能温化水液，泛溢肌肤；面色㿠白，是由于阳虚水气上泛（B对）。